年龄对疾病发生的影响
A. 无影响
B. 仅对非传染病发生有影响
C. 仅对传染病发生有影响
D. 影响不明显
E. 对传染病和非传染病发生均有影响

正确答案：E。对传染病和非传染病发生均有影响